对于月经的描述，错误的是
A. 月经血含有子宫内膜碎片，宫颈粘液及脱落的阴道上皮细胞
B. 月经血不凝主要是由于纤维蛋白的溶解
C. 正常经量约为80ml
D. 月经时子宫内膜从基底层脱落
E. 出血第一日为月经周期开始

正确答案：C。正常经量约为80ml

解析：月经血呈暗红色，除血液外，还有子宫内膜碎片、宫颈黏液及脱落的阴道上皮细胞。由于纤维蛋白溶酶对纤维蛋白的溶解作用，月经血不凝。出血多时可出现血凝块。出血第一日为月经周期开始。正常经量20～60ml，超过80ml称为月经过多。子宫内膜功能层从基底层崩解脱离，这是孕酮和雌激素撤退的最后结果。掌握“女性生殖系统生理”知识点。